釉质龋的基本病理变化可以概括为
A. 血肿和机化
B. 生长和发育
C. 感染与免疫
D. 脱矿与再矿化
E. 复制和传递

正确答案：D。脱矿与再矿化

解析：釉质龋虽然是一种细菌感染性疾病，但是病变具有其他任何感染性疾病所没有的特征，为一种非细胞反应性病变，基本变化为脱矿和再矿化。掌握“牙釉质龋”知识点。